患病率通常用来表示
A. 病程短的慢性病的发生或流行情况
B. 病程长的慢性病的发生或流行情况
C. 病程短的传染病的发生或流行情况
D. 暴发疾病的发生和流行情况
E. 流行疾病的发生和流行情况

正确答案：B。病程长的慢性病的发生或流行情况